单室模型静脉注射给药的药-时曲线是
A. 曲线②
B. 曲线⑤
C. 曲线①
D. 曲线③
E. 曲线④

正确答案：C。曲线①

解析：本题考查单室模型静脉注射。单室模型药物静脉注射给药后，药物很快随血液分布到机体各组织、器官中并达到平衡，血药浓度随时间变化的指数函数为C=C₀e⁻kt，如图①（C对）。